在十字花科蔬菜中具有抗微生物作用的植物化学物是
A. 硫化物
B. 皂苷
C. 植酸
D. 芥子油苷
E. 植物固醇

正确答案：D。芥子油苷